髁状突颈部骨折后髁状突常被拉向前内方是由于患侧
A. 颞肌的作用
B. 咬肌的作用
C. 翼内肌的作用
D. 翼外肌的作用
E. 关节韧带的作用

正确答案：D。翼外肌的作用

解析：髁突骨折：多数发生在翼外肌附着下方的髁突颈部。折断的髁突由于受翼外肌牵拉而向前、内移位，但仍可位于关节囊内；但如打击力过大，关节囊撕裂，髁突可从关节窝内脱位而向内、向前、向后或向外移位，移位的方向和程度，与外力撞击的方向及大小有关。个别情况下，髁突可被击入颅中窝。掌握“牙槽突骨折、颌骨骨折”知识点。